药物的日处方量趋于合理时DUI值接近
A. 2.5
B. 2
C. 1.5
D. 1
E. 0.5

正确答案：D。1

解析：本题考查药物利用指数。药物利用指数(DUI)：用来测量医师使用某药的日处方剂量，对医师用药剂量的合理性进行分析。DUI>1.0，医师的日处方剂量大于DDD，超过了推荐的限定日剂量；DUI<1.0，医师的日处方剂量小于DDD，可能剂量不足；DUl接近于1.0（D对），剂量使用基本合理。